治疗土拉菌病宜选用的药物是
A. 青霉素
B. 链霉素
C. 四环素
D. 红霉素
E. 氨曲南

正确答案：B。链霉素

解析：本题考查链霉素。链霉素（B对）是治疗土拉菌病的首选药。四环素（C错）也能用于治疗兔热病，但不是首选。青霉素（A错）能破坏细菌的细胞壁并在细菌细胞的繁殖期起杀菌作用。红霉素（D错）的抗菌谱与青霉素相似，且对支原体、衣原体、立克次体及军团菌有抗菌作用。氨曲南（E错）仅对需氧革兰阴性菌具有良好的抗菌活性。